解决中药品种混乱和复杂问题的途径主要有
A. 加强本草考正，以求正本清源
B. 对中药进行系统的品种整理和质量研究，力求名实相符
C. 规范各级药品标准，力求一名一物，一物一名
D. 实施《野生药材资源保护管理条例》，确保中药资源可持续利用
E. 实旅《药品注册管理办法》，规范新药研制

正确答案：A、C。加强本草考正，以求正本清源；规范各级药品标准，力求一名一物，一物一名

解析：本题考查的是解决中药品种混乱和复杂问题的途径。解决中药品种混乱和复杂问题的途径主要有加强本草考正，以求正本清源（A对）、规范各级药品标准，力求一名一物，一物一名（C对）。解决中药品种混乱和复杂问题的途径有：（1）力求一物一名，一名一物；（2）正确继承古人药材生产和用药经验；（3）开展古方药物的品种考证；（4）查考地方志；（5）本草考证有助于自认资源的开发利用；（6）本草考证与现今药材品种相结合。